引起颞下颌关节复发性脱位的病因是
A. 急性前脱位后未予以适当治疗，造成关节韧带、关节囊松弛
B. 长期翼外肌功能亢进，髁突运动过度，使关节囊、韧带松弛
C. 老年人、长期慢性消耗性疾病、肌张力失常
D. 颞下颌关节前脱位反复发作
E. 以上均包括

正确答案：E。以上均包括

解析：急性前脱位后未予以适当治疗，使得被撕裂的韧带、关节囊等未得到修复，造成关节韧带、关节囊松弛；其次由于长期翼外肌功能亢进，髁突运动过度，使关节囊、韧带松弛，也可造成复发性脱位；老年人、长期慢性消耗性疾病、肌张力失常等也常发生复发性脱位。掌握“颞下颌关节脱位”知识点。